关于临终关怀符合伦理学的原因，说法错误的是
A. 可以减轻家庭的经济负担
B. 可以减轻病人的痛苦
C. 缩短病人的痛苦的生命时限
D. 可以节约卫生资源
E. 以上说法都不对

正确答案：E。以上说法都不对

解析：本题考查临终关怀符合伦理学的原因。临终关怀的目的是使临终病人的生命质量得到提高，尽量舒适地走完最后的生命旅程，是符合人性化的要求的。实施了临终关怀，客观上可以达到这样的效果，比如可以减轻家庭的经济负担（A错）、可以减轻病人的痛苦（B错）、缩短病人的痛苦时间（C错），甚至可以节约卫生资源（D错）。但这不是进行临终关怀的初衷和目的。（ABCD均错，故E为本题的正确答案）。